慢性支气管炎单纯型的临床表现是
A. 长期、反复咳嗽、咳痰
B. 反复咳嗽、咳痰、喘息，并伴有哮鸣音
C. 咳嗽、咳痰，伴长期午后低热、消瘦、盗汗
D. 发作性带哮鸣音的呼气性呼吸困难
E. 夜间熟睡后突然憋醒，伴咳嗽、咳痰

正确答案：A。长期、反复咳嗽、咳痰

解析：慢性支气管炎分为单纯型和喘息型两种。单纯型主要表现为反复咳嗽、咳痰（A对）；喘息型除咳嗽、咳痰外尚有喘息症状，并伴有哮鸣音（B错）。咳嗽、咳痰，伴长期午后低热、消瘦、盗汗（C错）为肺结核表现。发作性带哮鸣音的呼气性呼吸困难（D错）为支气管哮喘的表现。夜间熟睡后突然憋醒，伴咳嗽、咳痰（E错）为心源性哮喘的表现。